两侧瞳孔大小不等，多见于
A. 有机磷农药中毒
B. 阿托品类药物影响
C. 吗啡药物影响
D. 濒死状态
E. 脑肿瘤

正确答案：E。脑肿瘤

解析：两侧瞳孔大小不等，多见于脑外伤、脑肿瘤、中枢神经梅毒、脑疝等（E对）。有机磷农药中毒及吗啡可致瞳孔缩小（AC错）。阿托品类药物影响可致瞳孔扩大（B错）。濒死状态表现为双侧瞳孔扩大伴瞳孔对光反射消失（D错）。